苷类化合物确定糖链结构要解决的问题是
A. 糖链中糖的元素比
B. 糖链中糖的种类和比例
C. 糖之间的连接位置
D. 糖之间的连接顺序
E. 糖之间苷键的构型

正确答案：B、C、D、E。糖链中糖的种类和比例；糖之间的连接位置；糖之间的连接顺序；糖之间苷键的构型

解析：本题考查的是苷键的裂解。苷类化合物确定糖链结构要解决的问题是糖链中糖的种类和比例（B对）、糖之间的连接位置（C对）、糖之间的连接顺序（D对）与糖之间苷键的构型（E对）。苷键裂解反应是研究多糖和苷类的重要反应。通过裂解反应使苷键切断，其目的在于了解组成苷类的苷元结构及所连接的糖的种类和组成，确定苷元与糖以及糖与糖之间的连接方式。糖链中糖的元素比（A错），2022年考试指南未明确说明。